下列WHO推荐的干预措施中，哪项是在个体水平上实施的
A. 提高税率
B. 公共场所和公共场所室内禁烟
C. 禁止烟草广告、促销和赞助
D. 筛查和治疗癌前病变
E. 减少食物中的食盐摄入

正确答案：D。筛查和治疗癌前病变